急性阑尾炎手术治疗后最常见的并发症是
A. 阑尾残株炎
B. 粘连性肠梗阻
C. 切口感染
D. 出血
E. 粪瘘

正确答案：C。切口感染

解析：切口感染（C对）是最常见的术后并发症，在急性化脓性或穿孔性阑尾炎中多见。阑尾残株炎（A错）指阑尾残端保留过长超过1厘米时，或者肠石残留，术后残株可炎症复发，仍表现为阑尾炎的症状，也偶见术中未能切除病变阑尾，而将其遗留，术后炎症复发。粘连性肠梗阻（B错）也是阑尾切除术后的较常见并发症，与局部炎症重、手术损伤、切口异物、术后卧床等多种原因有关。阑尾系膜的结扎松脱会引起系膜血管出血（D错），表现为腹痛、腹胀和失血性休克等症状。粪瘘（E错）很少见，产生术后粪瘘的原因有多种，阑尾残端单纯结扎，其结扎线脱落；盲肠原为结核、癌症等；盲肠组织水肿脆弱术中缝合时裂伤。